根据《中华人民共和国药品管理法实施条例》，实行政府定价或政府指导价的药品是
A. 列入国家基本医疗保险药品目录的药品
B. 列入国家基本药物目录的药品
C. 列入中华人民共和国药典的药品
D. 列入国家基本医疗保险药品目录以外生产和经营的常用药品
E. 列入国家基本药物目录以外生产和经营的具有垄断性药品

正确答案：A。列入国家基本医疗保险药品目录的药品

解析：本题考查实行药品市场调节价应当遵循的原则。根据《中华人民共和国药品管理法实施条例》，实行政府定价或政府指导价的药品是列入国家基本医疗保险药品目录的药品（A对）。实行药品市场调节价应当遵循的原则：2019年12月11日，为贯彻落实党中央、国务院关于药品保供稳价工作的决策部署，国家医疗保障局制定了《关于做好当前药品价格管理工作的意见》（医保发〔2019〕67号），要求依据《价格法》《药品管理法》，进一步完善药品价格形成机制。以现行药品价格政策为基础，坚持市场在资源配置中起的决定性作用，更好发挥政府作用，围绕新时代医疗保障制度总体发展方向，持续健全以市场为主导的药品价格形成机制。医疗保障部门管理价格的药品范围，包括化学药品、中成药、生化药品、中药饮片、医疗机构制剂等。其中，麻醉药品和第一类精神药品实行政府指导价，其他药品实行市场调节价。药品经营者（含上市许可持有人、生产企业、经营企业等）制定价格应遵循公平、合法和诚实信用、质价相符的原则，使药品价格反映成本变化和市场供求，维护价格合理稳定。同种药品在剂型、规格和包装等方面存在差异的，按照治疗费用相当的原则，综合考虑临床效果、成本价值、技术水平等因素，保持合理的差价比价关系。麻醉药品和第一类精神药品价格继续依法实行最高出厂（口岸）价格和最高零售价格管理，研究制定相应的管理办法和具体政策。其中，对国家发展改革委已按麻醉药品和第一类精神药品制定公布政府指导价的，暂以已制定价格为基础，综合考虑定价时间、相关价格指数的变化情况，以及麻醉药品和第一类精神药品通行的商业流通作价规则等因素，统一实施过渡性调整，作为临时价格执行。同时，按照“保障药品供应优先、满足临床需要优先”的原则，采取鼓励短缺药品供应、防范短缺药品恶意涨价和非短缺药品“搭车涨价”的价格招采政策，依职责参与做好短缺药品保供稳价工作。根据《基本医疗卫生与健康促进法》，国家建立健全药品价格监测体系，开展成本价格调查，加强药品价格监督检查，依法查处价格垄断、价格欺诈、不正当竞争等违法行为，维护药品价格秩序。同时，加强药品分类采购管理和指导。参加药品采购投标的投标人不得以低于成本的报价竞标，不得以欺诈、串通投标、滥用市场支配地位等方式竞标。